在我国实施人类辅助生殖技术，下列违背原卫生部制定的伦理原则的是
A. 使用捐赠的精子
B. 使用捐赠的卵子
C. 实施亲属代孕
D. 实施卵胞质内单精注射
E. 使用捐赠的胚胎

正确答案：C。实施亲属代孕